五行调节事物整体动态平衡的机制是
A. 生我
B. 我生
C. 克我
D. 我克
E. 制化

正确答案：E。制化

解析：五行制化调节即通过五行相生和相克的相互作用产生一种调节作用，使五行系统结构处于正常状态下，达到动态平衡（E对）。其中，任何两行的关系并不是单向的，而是相互的，而生我、我生、克我、我克均为单向的生克，故（ABCD错）。